老年性骨质疏松症的药物治疗方案宜选用
A. 钙制剂－维生素D－雌激素
B. 钙制剂－维生素D－双磷酸盐
C. 钙制剂-维生素D-甲状旁腺激素
D. 钙制剂-维生素D-雄激素
E. 钙制剂-维生素D-蛋白同化类固醇

正确答案：B。钙制剂－维生素D－双磷酸盐